心室肌细胞动作电位复极期内，只有强刺激才能引起兴奋的那段时间称作
A. 有效不应期
B. 相对不应期
C. 超常期
D. 低常期
E. 绝对不应期

正确答案：B。相对不应期